男性，45岁。较肥胖，因面颈部反复疖肿2个月就诊，无明显“三多一少”症状，空腹血糖7.6mmol/L，父母均为2型糖尿病患者，此时首选具有诊断意义的检查是
A. 100g法葡萄精耐量﹢C肽释放试验
B. 75g法葡萄糖耐量﹢胰岛素释放试验
C. 尿糖测定
D. 空腹血糖测定
E. 糖化血红蛋白测定

正确答案：B。75g法葡萄糖耐量﹢胰岛素释放试验